卫生服务组织不包括
A. 医疗机构
B. 群众性卫生组织
C. 疾病预防控制中心
D. 医疗保险公司
E. 预防保健机构

正确答案：B。群众性卫生组织

解析：卫生服务机构可分为医疗机构（A对）、公共卫生机构（C对）、妇幼保健机构（E对）、医学教育机构、医学科学研究机构，军队、企业医疗卫生服务机构（D对），以及其他卫生组织机构。群众性卫生组织和卫生服务组织同属卫生组织机构，它们是由广大群组织不包括群众性卫生组织（B错，为本题正确答案）。